下列需要急行胆道减压的疾病是
A. 急性胆囊炎
B. 胆囊结石
C. 肝内胆管结石
D. 急性梗阻性化脓性胆管炎
E. 胆囊结石嵌顿

正确答案：D。急性梗阻性化脓性胆管炎

解析：急性梗阻性化脓性胆管炎（D对）应急行胆道减压，才能中止胆汁或细菌向血液的反流，阻断病情恶化。急性胆囊炎（A错）、胆囊结石（B错）、胆囊结石嵌顿（E错）需行胆囊切除术；肝内胆管结石（C错）多需手术取石，病情严重时需切除相应肝段，以上疾病急行胆道减压不能治疗。